室性早搏常见的病因是
A. 电解质紊乱
B. 精神因素
C. 各种心脏病
D. 药物过量中毒
E. 手术刺激心肌

正确答案：C。各种心脏病

解析：室性期前收缩常见于各种心脏病（C对），如高血压、冠心病、心肌病、风湿性心脏病与二尖瓣脱垂，也可因缺氧、麻醉和手术刺激心肌（E错）、电解质紊乱（A错）、精神因素（B错）、药物过量中毒（D错）而诱发室性期前收缩出现，以上四种均作为诱因出现，而非病因。